下颌舌侧牙槽嵴形态为斜坡型者，舌杆应
A. 与黏膜平行，离开黏膜少许或轻轻接触
B. 与黏膜平行，不接触，离开黏膜3～4mm
C. 与黏膜平行，并紧密接触
D. 与黏膜垂直，并离开少许
E. 以上都不对

正确答案：A。与黏膜平行，离开黏膜少许或轻轻接触

解析：本题考查舌杆与黏膜的关系。下颌舌侧牙槽嵴形态为斜坡型者，舌杆应与黏膜平行，离开黏膜少许或轻轻接触（A对）。为防止义齿受力下沉后舌杆压迫软组织，舌杆与黏膜间应预留适当的缓冲间隙，若与黏膜紧密接触（C错）会产生压痛。缓冲量根据下颌舌侧牙槽骨的三种形态有所不同。斜坡型者舌杆与黏膜稍分离，缓冲量一般为0.3～0.5mm，即离开黏膜少许或轻轻接触（A对B错）。垂直型者舌杆与黏膜平行接触，缓冲量最小，对于倒凹形者舌杆应该在倒凹之上或在倒凹区留出空隙并在骨突区充分缓冲，不存在于黏膜垂直（D错）的情况。